关于中药材专业市场管理的说法，错误的是
A. 严禁销售假劣中药材
B. 严禁销售中药饮片以外的其他药品
C. 严禁销售国家规定的27种毒性药材
D. 严禁非法销售国家规定的42种濒危药材

正确答案：B。严禁销售中药饮片以外的其他药品

解析：本题考查的是中药材专业市场管理。中药材专业市场严禁未经批准以任何名义或方式经营中药饮片、中成药和其他药品（B错，为本题正确答案）。中药材专业市场管理：《药品管理法》及其实施条例规定，城乡集市贸易市场可以出售中药材，国务院另有规定的除外。另外，《关于进一步加强中药材管理的通知》指出：除现有17个中药材专业市场外，各地一律不得开办新的中药材专业市场。中药材专业市场所在地人民政府要按照“谁开办，谁管理”的原则，承担起管理责任，明确市场开办主体及其责任。中药材专业市场要建立健全交易管理部门和质量管理机构，完善市场交易和质量管理的规章制度，逐步建立起公司化的中药材经营模式。要构建中药材电子交易平台和市场信息平台，建设中药材流通追溯系统，配备使用具有药品现代物流水平的仓储设施设备，提高中药材仓储、养护技术水平，切实保障中药材质量。严禁销售假劣中药材（A对），严禁未经批准以任何名义或方式经营中药饮片、中成药和其他药品，严禁销售国家规定的27种毒性药材（C对），严禁非法销售国家规定的42种濒危药材（D对）。